男，吸烟四十余年，咳嗽胸闷，嗜睡，动脉血气分析：PH7.25，PaCO₂75mmHg，PaO₂34mmHg，BE⁺3。可诊断为什么疾病
A. 急性脑血管病
B. 支气管扩张
C. ARDS
D. 肺性脑病
E. 肝性脑病

正确答案：D。肺性脑病

解析：该患者男，吸烟四十余年（慢性支气管炎最重要的环境发病因素），出现咳嗽胸闷（慢阻肺表现），嗜睡，动脉血气分析：PH7.25，PaCO₂ 75mmHg，PaO₂ 34mmHg，BE⁺3（肺性脑病的表现），结合患者的表现和辅助检查的结果，诊断为肺性脑病（D对）。支气管扩张(B错)主要症状为持续或反复的咳嗽、咳痰或咳脓痰，痰液为黏液性、黏液脓性或脓性，可呈黄绿色，收集后分层：上层为泡沫，中间为浑浊黏液，下层为脓性成分，最下层为坏死组织。ARDS（C错）最早出现的症状是呼吸增快，并呈进行性加重的呼吸困难、发绀，常伴有烦躁、焦虑、出汗等。其呼吸困难的特点是呼吸深快、费力，病人常感到胸廓紧束、严重憋气。肝性脑病（E错）指在肝硬化基础上因肝功能不全和（或）门-体分流引起的以代谢紊乱为基础、中枢神经系统功能失调的综合征，约50%肝硬化病人有脑水肿，病程长者大脑皮质变薄，神经元及神经纤维减少。